食管癌分型不包括
A. 髓质型
B. 缩窄硬化型
C. 蕈伞形
D. 溃疡型
E. 梗阻型

正确答案：E。梗阻型

解析：食管癌按病理形态可分为髓质型（A对）、蕈伞型（C对）、溃疡型（D对）、缩窄硬化型（B对），无梗阻型（E错，为本题正确答案）。